小儿腹泻时低钾症状见于血钾（mmol/L）低于多少为诊断标准
A. 2
B. 2.5
C. 3
D. 3.5
E. 4

正确答案：D。3.5